男，35岁。左侧下颌第一磨牙种植义齿修复后3个月，1天前发现义齿松动。检查：牙冠（牙合）面可见树脂封闭的螺丝孔，牙冠Ⅰ度松动。X线片未见异常。义齿松动的原因可能是
A. 种植体折断
B. 基台折断
C. 种植体周围骨吸收
D. 中央螺丝松动
E. 牙冠粘结松动

正确答案：D。中央螺丝松动

解析：本题考查种植修复的并发症。男，35岁。左侧下颌第一磨牙种植义齿修复后3个月，1天前发现义齿松动。检查：牙冠（牙合）面可见树脂封闭的螺丝孔，牙冠Ⅰ度松动。X线片未见异常。义齿松动的原因可能是中央螺丝松动（D对）。种植体折断常伴严重骨吸收，X线片显示牙槽骨高度降低，骨结合长度不足（A错）；基台折断，X线片显示裂隙（B错）；种植体周围骨吸收，Ｘ线片显示种植体周围垂直或水平骨吸收（C错）；种植体上部结构螺丝的松动可引起牙冠松动；牙冠粘结强度不足，可导致修复后近期内便出现松动脱落（E错）。